关于心尖的描述，正确的是
A. 朝向下方
B. 朝向左下方
C. 朝向左前下方
D. 朝向右前下方
E. 平对左侧第五肋间锁骨中线外侧1～2cm

正确答案：C。朝向左前下方

解析：心尖朝向左前下方（C对）。由左心室构成，平对左侧第五肋间锁骨中线内侧（E错）1～2cm。